根据《医疗机构药师管理规定》，药师对医师处方用药适宜性审核的依据不包括
A. 药物临床应用指导原则
B. 临床路径
C. 临床诊疗指南
D. 药品说明书
E. 药品价格

正确答案：E。药品价格

解析：本题考查的是处方审核的定义。根据《医疗机构药师管理规定》，药师对医师处方用药适宜性审核的依据不包括药品价格（E错，为本题正确答案）。处方审核的定义：处方审核是指药学专业技术人员运用专业知识与实践技能，根据相关法律法规、规章制度与技术规范等，对医师在诊疗活动中为患者开具的处方，进行合法性、规范性和适宜性审核，并作出是否同意调配发药决定的药学技术服务。审核的处方包括纸质处方、电子处方和医疗机构病区用药医嘱单。《药品管理法》规定，医疗机构应当坚持安全有效、经济合理的用药原则，遵循药品临床应用指导原则（A对）、临床诊疗指南（C对）和药品说明书（D对）等合理用药，对医师处方、用药医嘱的适宜性进行审核。